人感染流感病毒产生的主要的保护性抗体是
A. 抗MP抗体
B. 抗NA抗体
C. 受病毒抗原诱导的细胞毒性T细胞及辅助T细胞
D. 抗NP抗体
E. HA抗体

正确答案：E。HA抗体

解析：本题考查人感染流感病毒产生的主要的保护性抗体。人感染流感病毒后可产生三种抗体：血凝素抗体、神经氨酸酶抗体和核蛋白抗体。其中血凝素抗体（HA抗体）（E对ABCD错）是主要的保护性抗体，它能结合并覆盖病毒的吸附位点，从而使流感病毒降低或失去吸附细胞的能力，因此能中和病毒。